来源为十字花科植物独行菜或播娘蒿干燥成熟种子的药材是
A. 蛇床子
B. 牛蒡子
C. 鹤虱
D. 补骨脂
E. 葶苈子

正确答案：E。葶苈子

解析：本题考查的是葶苈子的来源。来源为十字花科植物独行菜或播娘蒿干燥成熟种子的药材是葶苈子（E对）。葶苈子：【来源】为十字花科植物播娘蒿或独行菜的干燥成熟种子。前者习称“南葶苈子”，后者习称“北葶苈子”。蛇床子（A错）：【来源】为伞形科植物蛇床的干燥成熟果实。牛蒡子（B错）：【来源】为菊科植物牛蒡的干燥成熟果实。补骨脂（D错）：【来源】为豆科植物补骨脂的干燥成熟果实。鹤虱（E错）的来源，2022年考试指南未明确说明。